男，78岁。腰骶部疼痛2个月。直肠指诊前列腺增大，有结节，质地坚硬且侵犯直肠，血清PSA80.6ng/ml，前列腺穿刺活检诊断前列腺癌，放射性核素骨显像见腰椎转移病灶。该患者临床分期是
A. T4期
B. T1期
C. T2a期
D. T2b期
E. T3期

正确答案：A。T4期

解析：前列腺癌临床分期多采用TNM分期系统，分为4期。T1期（B错）分为T1a期：偶发肿瘤体积＜所切除组织体积的5%，直肠指检正常；T1b期：偶发肿瘤体积＞所切除组织体积的5%，直肠指检正常；T1c期：单纯PSA升高，穿刺活检发现肿瘤，直肠指检及经直肠超声正常。T2期分为T2a期（C错）：肿瘤局限于并＜单叶的1/2；T2b期（D错）：肿瘤局限于并＞单叶的1/2；T2c期：肿瘤侵犯两叶，但仍局限于前列腺内。T3期（E错）分为T3a期：肿瘤侵犯并突破前列腺一叶或两叶包膜；T3b期：肿瘤侵犯精囊。T4期：肿瘤侵犯膀胱颈、尿道外括约肌、直肠、肛提肌和（或）盆壁。该患者前列腺癌已侵犯直肠，且有腰椎转移，为T4期表现（A对）。